男性，66岁。无痛性肉眼血尿伴条状血块2个月。B超可见左肾轻度积水。2次细胞学检查未见癌细胞。若检查发现左肾盂内似有充盈缺损，尿细胞学检查为可疑细胞，进一步选择什么方法检查
A. CT
B. MRI
C. IVU
D. 左肾逆行造影
E. 左肾穿刺造影

正确答案：A。CT

解析：老年男性患者，无痛性肉眼血尿伴条状血块（提示可能为上尿路肿瘤），B超示左肾轻度积水（提示左侧上尿路梗阻），检查发现左肾盂内似有充盈缺损， 结合患者临床表现和相关检查，应考虑为左侧肾盂肿瘤。静脉尿路造影是诊断肾盂、输尿管癌的传统方法（D错）。CT增强 +三维重建（CTU）是诊断肾盂、输尿管癌的首要手段（A对）、MRI（B错）对上尿路肿瘤的诊断及与其他疾病的鉴别诊断有较好的应用价值，但单纯影像学检查并不能确诊。IVU（C错）显影不如逆行造影清晰，且不能明确充盈缺损的原因。左肾穿刺造影（E错）创伤较大，一般不作首选检查。